刷牙是预防牙周疾病的好方法，下面哪种提法更好些
A. 正确刷牙
B. 早晚刷牙
C. 认真刷牙
D. 有效刷牙
E. 饭后刷牙

正确答案：D。有效刷牙

解析：有效刷牙是指采用适当的方法最大限度地清除牙菌斑但又不损伤牙齿和牙龈。掌握“自我口腔保健方法”知识点。